较易导致肾损伤的药品是
A. 布洛芬
B. 酮康唑
C. 环孢素
D. 比沙可啶
E. 氯化钾

正确答案：A。布洛芬

解析：本题考查药源性疾病。布洛芬（A对）为非甾体抗炎药，通过抑制肾脏的环氧酶，从而使前列腺素合成障碍，易引起多种肾损害。酮康唑（B错）易导致药物性肝损伤。环孢素（C错）不良反应常见的有厌食、恶心、呕吐等胃肠道反应。比沙可啶（D错）对肝肾影响相对较小。氯化钾（E错）口服过量有毒，但肾毒性较小。